肾病综合征预防性抗凝治疗的指征是
A. 出现尿频尿急尿痛
B. 出现血尿
C. 出现蛋白尿
D. 血浆蛋白＜20g/L
E. 出现水肿

正确答案：D。血浆蛋白＜20g/L

解析：肾病综合征患者容易发生血栓，其中以肾静脉血栓最为常见。血栓形成的原因有高血脂、水肿、静脉淤滞、患者活动少、使用肾上腺皮质激素等，以上因素都可以导致血液处于高凝状态，从而发生血栓及栓塞并发症，一般认为，当血浆白蛋白低于20g/L时，提示存在高凝状态，即应开始预防性抗凝治疗（D对）。尿频、尿急、尿痛（A错）提示泌尿系统感染，应该及时抗生素治疗，并非预防性抗凝的指征。出现蛋白尿（C错）、水肿（E错）应该对症治疗，即利尿消肿和减少蛋白尿，均不是预防性抗凝的指征。血尿（B错）出现在肾病综合征患者时提示已经出现肾静脉栓塞，此时不再是预防性抗凝。